牙周病的流行特征的描述中，错误的是
A. 发展中国家的龈炎、牙石等的患病程度高于发达国家
B. 牙周病患病率随年龄增长而增高
C. 农村居民的患病程度高于城市居民
D. 多数报告为男性重于女性
E. 与民族无关系

正确答案：E。与民族无关系

解析：在牙周病的流行特征中不同民族牙周病的患病情况差异很大，这可能与民族之间的社会经济、环境文化、饮食卫生习惯等差异有关。如我国少数民族中龈炎患病率最低的是朝鲜族，最高的是彝族。掌握“牙周病流行病学及分级预防”知识点。